男性充盈性尿失禁的常见原因是
A. 使用利尿剂
B. 输尿管结石
C. 前列腺增生
D. 下尿路感染
E. 直肠脱垂

正确答案：C。前列腺增生

解析：充盈性尿失禁指膀胱失去收缩能力，呈慢性扩张，并且从未完全排空，当膀胱过度充盈后，尿液不能自主控制而从尿道口冲出，常见于各种慢性尿潴留，男性以前列腺增生（C对）最为常见。使用利尿剂（A错）后尿量增多，排尿增多且受患者意识控制，不属于尿失禁。输尿管结石（B错）主要表现为肾绞痛和血尿。下尿路感染（D错）多引起急迫性尿失禁。直肠脱垂（E错）主要症状为直肠粘膜自肛门脱出，伴有排便不尽和下坠感，不会出现充盈性尿失禁。